大豆中导致胃肠胀气的物质
A. 皂苷和异黄酮类
B. 水苏糖和棉籽糖
C. 植酸
D. 植物血细胞凝集素
E. 蛋白酶抑制剂

正确答案：B。水苏糖和棉籽糖